特发性中枢性性早熟的临床表现特征是
A. 一男孩多见，占男孩性早熟的80%以上
B. 骨龄发育落后
C. 患儿身高及体重增长减慢
D. 绝大多数在4-8岁出现，也有婴儿期发病者
E. 发育顺序与正常青春发育不同

正确答案：D。绝大多数在4-8岁出现，也有婴儿期发病者

解析：特发性中枢性性早熟起病年龄超过70%在4-8岁，18%在婴儿期（D对）。特发性中枢性性早熟又称为体质性性早熟，多见于女性（A错）。性早熟患儿发育多提前，由于过早发育引起患儿近期蹿长，骨骼生长加速，骨龄提前，骨骺可提前融合，影响终身高（BC错）。中枢性性早熟临床表现中第二性征发育的顺序与正常发育是一致的，但是明显提前并且加速（E错）。